下列哪项不是右心衰的主要临床表现
A. 水肿
B. 静脉压升高
C. 肝肿大
D. 颈静脉怒张
E. 肺循环时间缩短

正确答案：E。肺循环时间缩短

解析：右心衰时，右室输出量减少，导致心脏舒张期时存留于右室的血液增多，充盈压升高，使体循环血液回流入右心的阻力增加，造成体循环淤血，临床表现为水肿（A错）、静脉压升高（B错）如颈静脉怒张（D错）、肝肿大（C错）及肝功能损害、消化系统功能障碍。肺循环时间缩短（E对）不是右心衰的临床表现。